工间休息方式的确定主要是根据
A. 每天的工作量
B. 作业的特点
C. 多数人员的疲劳状况
D. 企业的管理模式
E. 职工技术熟练程度

正确答案：B。作业的特点